恒牙建（牙合）的关键是
A. 第1恒磨牙的关系
B. 第2恒磨牙的关系
C. 保证第1恒磨牙无龋坏
D. 保证第2恒磨牙无龋坏
E. 及时进行第1、2恒磨牙的窝沟封闭

正确答案：A。第1恒磨牙的关系

解析：本题考查恒牙建（牙合）的关键。牙尖交错（牙合）时，正常时上颌第一磨牙的近中颊尖对着下颌第一磨牙的颊沟，下颌第一磨牙的远中尖对着上颌第一磨牙的中央窝。第1恒磨牙的关系常被称为（牙合）的关键（A对）。第2恒磨牙的关系不稳定，且其（牙合）关系的建立需要第一磨牙的引导（B错）。及时进行第1、2恒磨牙的窝沟封闭能预防龋齿的发生（E错）。